青少年根尖周病最好选用哪种治疗法
A. 干髓术
B. 根充术
C. 塑化疗法
D. 安抚疗法
E. 空管疗法

正确答案：B。根充术

解析：本题考查青少年根尖周病的治疗方法。根充术指根管治疗术，用生物性良好的材料严密充填根管，消除无效腔。青少年根尖周病最好选用根充术（B对）进行治疗，能够有效消除根管系统的渗漏途径，防止根尖周组织液、细菌及其产物进入根管。干髓术（A错）治疗后根髓组织不易被干髓剂完全干尸化，常出现牙根吸收及根尖周病变再发生的不良后果。塑化治疗（C错）是指将根管内部分牙髓抽出，不必进行扩大根管等复杂的操作步骤，将配制好的塑化液注入根管内，与牙髓组织聚合一体，达到消除病源刺激物的作用。但容易出现塑化不彻底，塑化剂刺激根尖周组织，引发根尖囊肿。安抚疗法（D错）主要用于可复性牙髓炎，以安抚受刺激的牙髓，使其恢复健康状态，对于已感染的根尖周病无治疗效果。空管疗法（E错）是覆盖在根管口的药物通过扩散和毛细血管作用对根管起到杀菌抑菌的作用，适用于年龄较大者后牙多根管的治疗，但治疗后不能有效封闭根管，根尖周组织液容易进入，造成再感染。根尖炎未愈合的年轻恒牙，单根管牙，需要桩冠的牙应避免使用。